同时服用消渴丸和格列本脲，出现低血糖反应属于
A. 剂型差错
B. 重复用药
C. 速率差错
D. 用法差错
E. 配置差错

正确答案：B。重复用药

解析：本题考查重复用药。消渴丸成分中含有格列本脲，两者同时服用使格列本脲累加，出现低血糖反应，这种现象属于重复用药（B对）。剂型差错（A错）见于不经处方者同意而将片剂粉碎。速率差错（C错）常见于静滴。用法差错（D错）指操作技术不当。配置差错（E错）指药物在溶解或稀释时发生错误，或发生配伍变化。